可引起心室收缩时颈静脉搏动的疾病是
A. 高血压性心脏病
B. 三尖瓣关闭不全
C. 主动脉瓣关闭不全
D. 甲状腺功能亢进症
E. 严重贫血

正确答案：B。三尖瓣关闭不全

解析：颈静脉怒张伴有正性颈静脉搏动多见于严重充血性右心衰竭伴重度三尖瓣关闭不全时（功能性或器质性），同时可见患者四肢尖端（如手指）的静脉有随心脏收缩的收缩期搏动（B对）。高血压性心脏病的体征是胸骨右缘第2肋间搏动（A错）。主动脉瓣关闭不全体格检查常常发现动脉血压的舒张压降低，心脏可听到舒张期杂音（C错）。.甲状腺功能亢进症的重症患者用听诊器可以听到全期的血管杂音，严重甲亢甚至用手触摸有震颤（D错）。贫血时心悸为最突出的症状之一，有心动过速，在心尖或肺动脉瓣区可听到柔和的收缩期杂音，称为贫血性杂音，严重贫血可听到舒张期杂音（E错）。